风心病患者，突发呼吸困难，咳粉红色泡沫痰，血压120/80mmHg，心率140次/分，心律绝对不齐。首选药物是
A. 普罗帕酮（心律平）
B. 利多卡因
C. 毛花甙丙（西地兰）
D. 可拉明
E. 胺碘酮

正确答案：C。毛花甙丙（西地兰）

解析：风心病患者突发呼吸困难，咳粉红色泡沫痰（急性左心衰竭特征性痰液），血压正常，心率140次/分（正常值60～100次/分，偏快），心律绝对不齐（心房颤动典型体征），考虑诊断为急性左心衰竭伴心房颤动。毛花甙丙（西地兰）（C对）静脉给药最适合用于有快速心室率的心房颤动伴左心室收缩功能不全者，为本例首选治疗药物。普罗帕酮（心律平）（A错）和胺碘酮（E错）在房颤患者治疗中主要用于转复窦性心律，其中普罗帕酮因可致室性心律失常，慎用于严重器质性心脏病患者，而胺碘酮不能改善患者由于急性左心衰竭导致的肺水肿症状。利多卡因（九版药理学P196）（B错）主要治疗室性心律失常，如心脏手术、心导管术、急性心肌梗死或强心苷中毒所致的室性心动过速或心室纤颤。